手三阴经与足三阴经交接的部位是
A. 手指端
B. 足趾端
C. 头面部
D. 胸中
E. 腹部

正确答案：D。胸中

解析：手太阴肺经和手阳明大肠经在食指端交接，手少阴心经和手太阳小肠经在小指端交接，手厥阴心包经和手少阳焦经在无名指端交接（A错）；足阳明胃经和足太阴脾经在足大趾交接，足太阳膀胱经和足少阴肾经在足小趾交接，足少阳胆经和足厥阴肝经在足大趾爪甲后交接（B错）；手阳明大肠经与足阳明胃经在鼻翼旁交接，手太阳小肠经与足太阳膀胱经在目内眦交接，手少阳三焦经与足少阳胆经在目外眦交接（C错）；足太阴脾经与手少阴心经在心中交接，足少阴肾经与手厥阴心包经在胸中交接（D对），足厥阴肝经与手太阴肺经在肺中交接。